关于蜗管的描述错误是
A. 位于蜗螺旋管内
B. 介于骨螺旋板和蜗螺旋管外侧壁之间
C. 蜗管顶端通蜗孔
D. 水平断面呈三角形
E. 无

正确答案：C。蜗管顶端通蜗孔

解析：蜗螺旋管内为膜性的蜗管（A对）。在水平断面上，蜗管呈三角形（D对），有上壁、外侧壁和下壁，蜗管介于骨螺旋板和蜗螺旋管外侧壁之间（B对）。蜗管盘绕蜗轴两圈半庭端借连合管与球囊相连通，顶端终于蜗顶（C错，为本题正确答案）。